中风后遗口眼歪斜者，多由风痰阻络所致，宜选用
A. 牵正散
B. 解语丹
C. 补阳还五汤
D. 涤痰汤
E. 川芎茶调散

正确答案：A。牵正散

解析：中风急性阶段经治疗后进入恢复期，但是仍会有后遗症，其中的口眼歪斜是由风痰阻于头面，阳明经脉受损所导致的，而牵正散是治疗风中经络，口眼歪斜的常用方，可以祛风、除痰、通络（A对）。解语丹搜风化痰，行瘀通络，主治风痰阻于廉泉，舌强不语等（B错）。补阳还五汤益气养血，化瘀通络，为气虚络瘀证之中风恢复期的代表方（C错）。涤痰汤化痰息风，宣郁开窍，为痰浊瘀闭证之中风的代表方（D错）。川芎茶调散疏散风寒止痛，为风寒头痛的代表方（E错）。